典型心绞痛发作时，面对缺血区的导联ST段的改变为
A. 延长
B. 缩短
C. 不变
D. 下移
E. 抬高

正确答案：D。下移

解析：典型心绞痛发作时面对缺血区的导联上出现ST段下移，可呈水平型或下斜型压低≥0.1mV，或在原有的基础上进一步下移达0.1mV以上（D对）。ST段延长：ST段正常时间为0.05～0.15s。当其时间≥0.16s时，便称为ST段延长。见于低钙血症、心内膜下心肌缺血、Q-T间期延长综合征、三度房室传导阻滞伴缓慢心室率、阿一斯综合征发作后等（A错）。凡是使用儿茶酚胺类及洋地黄类药物、高钙血症、心肌急性缺血、缺氧、损伤时致细胞膜受损引起钙离子持续内流，均可使ST段缩短或消失（B错）。ST段抬高型心肌梗死的陈旧期∶此期出现于梗死发生后数月或数年，以坏死型Q波稳定不变为进入陈旧期的标志。ST段和T波恢复正常（C错）。变异型心绞痛ST段抬高（E错）。